但热不寒不包括
A. 阴虚潮热
B. 寒热往来
C. 阳明潮热
D. 湿温潮热
E. 高热不退

正确答案：B。寒热往来

解析：本题考查的是但热不寒的临床意义。但热不寒不包括寒热往来（B错，为本题正确答案）。但热不寒的临床意义：但热不寒，指的是在疾病过程中，患者唯感有热而没有寒象，同时怕热，此类症状多属热证的表现。发热不恶寒而但恶热，临床常见有以下几种情况。（1）壮热：壮热，指患者高热不退（E对）、不恶寒反恶热，称为壮热。多见于风寒入里化热，或风热内传的里实热证。（2）潮热：潮热，指发热如潮有定时、按时而发或按时而热更甚的（一般多在下午），即为潮热。临床常见有三种情况：①阴虚潮热（A对）；②湿温潮热（D对）；③阳明潮热（C对）。（3）长期低热：长期低热，指发热日期较长，而热度仅较正常体温稍高（一般不超过38℃），或仅患者自觉发热而体温并不高者。长期低热的病机比较复杂。寒热往来的临床意义：寒热往来，指恶寒与发热交替发作，是半表半里证的特征，为邪气虽不太盛，正气却也不强，邪气既不能侵入于里，正气也不能祛邪使之出表，正邪交争，两不相下的表现。